创造性问题解决模式不包括哪个阶段
A. 准备阶段
B. 酝酿阶段
C. 豁朗阶段
D. 验证阶段
E. 验算阶段

正确答案：E。验算阶段